胸主动脉
A. 位于脊柱右侧
B. 在第12胸椎高度穿过膈
C. 脏支较壁支粗大
D. 发出12对肋间后动脉
E. 壁支有膈上动脉等

正确答案：E。壁支有膈上动脉等

解析：胸主动脉初沿脊柱的左侧（A错）下行，逐渐转向其前方。在第10胸椎（B错）高度穿过膈的主动脉裂孔。脏支较壁支细小（C错）。共发出9对（D错）肋间后动脉。壁支有膈上动脉（E对）、肋间后动脉、肋下动脉。